通过抑制血管紧张素转化酶活性而降低血压的药物是
A. 普萘洛尔
B. 可乐定
C. 利血平
D. 哌唑嗪
E. 卡托普利

正确答案：E。卡托普利

解析：卡托普利通过抑制ACE，拮抗血管紧张素Ⅰ转换为血管紧张素Ⅱ，从而产生以下作用∶①扩张血管，使血压下降（E对）。